眼球后端由视神经连于
A. 端脑
B. 间脑
C. 小脑
D. 中脑
E. 脑桥

正确答案：B。间脑

解析：眼球后端由视神经连于间脑（B对）。